羚羊角入煎剂时应
A. 另煎
B. 烊化后冲服
C. 不宜久煎
D. 与其他药同煎
E. 先煎

正确答案：A。另煎

解析：本题考查的是羚羊角的用法用量。羚羊角入煎剂时应另煎（A对）。羚羊角：【用法用量】内服：煎汤，1～3g，宜另煎2小时以上，与煎好的药液合兑；磨汁或挫末，每次0.3～0.6g；也可入丸散。饴糖：用法用量】内服：入汤剂，30～60g，分次烊化冲服（B错）；或入丸散。薄荷：【用法用量】内服：煎汤，2～10g；或入丸散；不宜久煎（C错），入汤剂当后下。外用：适量，鲜品捣敷或捣汁涂，也可煎汤洗或含漱。其叶长于发汗，梗偏于理气。与其他药同煎（D错）为未作特殊说明的中药的用法。石决明：【用法用量】内服：煎汤，6～20g，打碎先下（E错）；或入丸散。外用：适量，点眼。平肝清肝宜生用，点眼应煅后水飞用。